以下不是腭裂形成的因素是
A. 感染
B. 射线
C. 药物
D. 激素
E. 运动

正确答案：E。运动

解析：与腭裂发生有关的因素有感染、射线、药物、激素和营养等。掌握“腭部与舌的发育”知识点。